以下哪项的具体做法是为个体和群体提供科学的健康信息来改善健康
A. 健康评估
B. 健康咨询
C. 健康教育
D. 健康管理
E. 疾病预防

正确答案：D。健康管理

解析：健康管理的具体做法是为个体和群体（包括政府）提供有针对性的、科学的健康信息并创造条件采取行动来改善健康。掌握“临床预防服务概述”知识点。